肺称“华盖”，是因为
A. 易受邪侵
B. 不耐寒侵
C. 不耐热侵
D. 不耐燥湿
E. 在人体脏腑中位置最高

正确答案：E。在人体脏腑中位置最高

解析：肺位于胸腔，覆盖五脏六腑，位置最高，故称为华盖。（E对）。